唇舌病变使用双合诊检查时，应该
A. 双手置于病变上下或两侧
B. 双手食指置于病变上下或两侧
C. 一手的食指和拇指置于病变上下或两侧
D. 一手的食指和中指置于病变上下或两侧
E. 一手的食指和另一手的拇指置于病变上下或两侧

正确答案：C。一手的食指和拇指置于病变上下或两侧

解析：本题考查双合诊检查。唇舌病变使用双合诊检查时，应该一手的食指和拇指置于病变上下或两侧（C对）。唇舌病变使用双合诊检查时应该以一手的食指和拇指置于病变上下或两侧由后向前进行，称为双指双合诊。双手置于病变部位上下或两侧（A错）用于口底、下颌下检查，称为双手双合诊。双合诊检查可以准确了解病变的范围、质地、动度以及有无压痛、触痛和浸润等。双手食指（B错）、一手的食指和中指（D错）、一手的食指和另一手的拇指（E错）置于病变上下或两侧都是错误的双合诊检方法，不能很好的感知病变质地、动度等。